10岁，右大腿下端疼痛伴高热达39.5℃1天。怀疑为急性化脓性骨髓炎。体格检查有力的证据是
A. 右股骨下端皮温升高
B. 右股骨下端（干骺端）深压痛
C. 右股骨下端肿胀
D. 局部血管充盈怒张
E. 右膝关节伸屈受限

正确答案：B。右股骨下端（干骺端）深压痛

解析：10岁儿童（急性化脓性骨髓炎的好发年龄，好发于儿童和青少年），右大腿下端疼痛（化脓性骨髓炎的好发部位，多发于胫骨近端和股骨远端）伴高热达39.5℃（正常值为36℃～37℃）1天（早期），结合该患者的临床表现和体征，该患者的诊断考虑为急性化脓性骨髓炎。急性化脓性骨髓炎起病急，有寒战，继而高热至39℃以上有明显的脓毒症症状。早期患区剧痛而抗拒作主动与被动运动，而不是伸屈受限（E错），肿胀并不明显（C错）。有局限性压痛，数天后压痛更为明显，说明该处已形成骨膜下脓肿（B对）。虽然局部皮温升高也是临床表现之一，但是并不能说明太多问题，其他疾病也可引起局部皮温升高（A错）